有关支气管扩张（支扩）发病机制描述不正确的是
A. 反复感染导致细支气管周围肺组织纤维化使支气管变形扩张
B. 支扩患者必在婴幼儿时期有过麻疹、支气管肺炎等感染
C. 支气管-肺组织感染和阻塞是支扩发病的主要因素
D. 肺结核纤维组织增生和收缩牵引亦可引起支扩
E. 支气管先天发育异常引起支扩相对少见

正确答案：B。支扩患者必在婴幼儿时期有过麻疹、支气管肺炎等感染

解析：支扩患者多在婴幼儿时期有过麻疹、支气管肺炎等感染。反复继发的感染也可以引起支扩。其余选项都正确。故选B。掌握“支气管扩张”知识点。